增龄性因素引起的牙周上皮细胞层次减少，致使上皮变薄，结缔组织成分减少等，为以上哪项
A. 牙周萎缩
B. 牙周炎
C. 龈增生
D. 慢性龈炎
E. 剥脱性龈病损

正确答案：A。牙周萎缩

解析：本题考查牙周萎缩。增龄性因素引起的牙周上皮细胞层次减少，致使上皮变薄，结缔组织成分减少等，为牙周萎缩（A对）。牙周萎缩在临床上主要指的是牙龈退缩。增龄也可引起牙周萎缩，又称为老年性萎缩，组织病理学变化并不明显，主要表现为上皮细胞各层次减少，致使上皮变薄，结缔组织成分减少，可见毛细血管扩张。